男，40岁。右大腿挤压伤后发生化脓性感染10天。观察中血压下降至80/60mmHg，脉细速。其扩容治疗应首选
A. 葡萄糖溶液
B. 平衡盐溶液
C. 全血
D. 血浆
E. 碳酸氢钠溶液

正确答案：B。平衡盐溶液

解析：患者化脓性感染10天，血压下降，脉细速，应诊断为感染性休克。其扩容治疗首先以输注平衡盐溶液（B对）为主，配合适当的胶体液、血浆（D错）或全血（C错），恢复足够的循环血量。血浆渗透压主要取决于晶体渗透压，而晶体渗透压约80%来自NaCl，故补液时一般先输注盐溶液迅速提高血浆渗透压，再输注葡萄糖溶液（A错）。即休克的总的治疗原则为“先晶后胶、先盐后糖、先快后慢”。休克常伴发酸中毒，但目前多主张宁酸勿碱，因为酸性环境能增加氧和血红蛋白的解离，从而增加向组织释氧，对复苏有利。因此不宜早期选用碳酸氢钠溶液（E错）。